有辛凉轻剂之称的是
A. 参苏饮
B. 柴葛解肌汤
C. 银翘散
D. 桑菊饮
E. 麻杏石甘汤

正确答案：D。桑菊饮

解析：桑菊饮用桑叶、菊花配伍杏仁，肃肺止咳之力大，而解表清热逊于银翘散，故为"辛凉轻剂"（D对）。参苏饮（A错）为治疗气虚外感风寒，内有痰湿证之常用方。柴葛解肌汤（B错）的配伍特点为温清相伍，三阳并举，表里同治，重在疏泄透散。银翘散（C错）为辛凉平剂，是治疗风温初起之常用方。麻杏石甘汤（E错）为辛凉重剂。